当小儿出现脾胃病时，应特别注意询问的是
A. 预防接种史
B. 生长发育史
C. 喂养史
D. 家族史
E. 胎产史

正确答案：C。喂养史

解析：当小儿出现脾胃病时，应特别注意询问喂养史（C对），对婴幼儿要询问喂养方式，人工喂养儿要了解乳品种类、调制方式和量，辅食添加情况，年长儿要询问食欲、饮食习惯、有否偏食等。预防接种史（A错）为需要与传染病鉴别时应特别注意询问的内容。生长发育史（B错）为小儿患有神经系统或内分泌系统疾病时应特别注意询问的内容。家族史（D错）为小儿患有具有遗传倾向疾病时应特别注意询问的内容。胎产史（E错）为新生儿期疾病应特别注意询问的内容。